患者，女，65岁。诊断为骨质疏松症，给予鲑降钙素注射液治疗，用药期间需注意的事项有
A. 应当注意有无皮下和牙龈出血
B. 必须补充足量的钙剂和维生素D
C. 对蛋白质过敏者，使用前需做皮肤敏感试验
D. 可能出现低血糖反应
E. 常出现面部潮红的不良反应

正确答案：B、C、E。必须补充足量的钙剂和维生素D；对蛋白质过敏者，使用前需做皮肤敏感试验；常出现面部潮红的不良反应

解析：本题考查鲑降钙素的使用。鲑降钙素在骨质疏松症治疗时，宜同时补充足量的钙剂和维生素D（B对）。鲑降钙素皮下或肌内注射或静脉滴注后可致面部、手部潮红（E对），多见于20%～30%患者。皮下和牙龈出血（A错）属于抗血栓药常见不良反应。低血糖反应（D错）一般见于降血糖药。对降钙素过敏者。应用前应作皮肤敏感试验，对蛋白质过敏者可能对降钙素过敏，应用前宜作皮肤敏感试验（C对）。